依据《传染病防治法》，我国法定的传染病共有
A. 甲、乙、丙三类32种
B. 甲、乙、丙三类34种
C. 甲、乙、丙三类35种
D. 甲、乙、丙三类36种
E. 甲、乙、丙三类40种

正确答案：E。甲、乙、丙三类40种